发病时天枢穴有压痛的疾病是
A. 胃炎
B. 消化性溃疡
C. 急性胰腺炎
D. 胆囊炎
E. 心绞痛

正确答案：C。急性胰腺炎

解析：急性胰腺炎腹痛为主要表现和首发症状，部位多位于上腹中部，可为钝痛、刀割样痛、钻痛或绞痛，呈阵发性加重，天枢穴位于腹部，肚脐正中旁开两寸，恰为急性胰腺炎（C对）的压痛部位。胃炎（A错）疼痛部位在左上腹部。消化性溃疡（B错）疼痛位于中上腹，也可出现在胸骨剑突后，甚或放射至背部，若发生穿孔，则表现为全腹弥漫性疼痛。胆囊炎（D错）疼痛位于右上腹。心绞痛（E错）疼痛主要在胸骨上段或中段之后，可波及心前区。